我国的《文化娱乐场所卫生标准》对以下项目提出了卫生要求，除了
A. 有效温度
B. 新风量
C. 空气细菌总数
D. 二氧化碳
E. 噪声

正确答案：A。有效温度

解析：本题考查《文化娱乐场所卫生标准》。我国的《文化娱乐场所卫生标准》对新风量（B对）、细菌总数（C对）、二氧化碳（D对）、噪声（E对）等项目提出了卫生要求，除了有效温度（A错，为本题正确答案）。